劳动卫生学是预防医学中的一个
A. 三级学科
B. 分支学科
C. 子学科
D. 一级学科
E. 重要学科

正确答案：B。分支学科

解析：本题考查劳动卫生学的定位。职业卫生学以前称劳动卫生学，曾是一门独立的预防医学分支学科（B对ACDE错），是以职业人群为主要对象，主要研究劳动条件对职业人群健康的影响，主要任务是识别、评价、预测、控制和研究不良劳动条件，为保护职业从事者健康、提高作业能力、改善劳动条件所应采取的措施提供科学依据。